牙槽突裂植骨手术的术后处理不正确的是
A. 应用漱口水漱口
B. 术后软食1—2周
C. 7—10天拆线
D. 如发生创口裂开，局部可用过氧化氢溶液+复合抗生素液+生理盐水交替冲洗
E. 给予抗生素3-5天

正确答案：C。7—10天拆线

解析：本题考查牙槽突裂的术后处理。牙槽突裂植骨手术后10-14天拆线（C错，为本题的正确答案）。术后应用漱口水，以保持口腔卫生（A对）；术后软食1-2周（B对），减少局部活动，防止创口裂开；如发生创口裂开，局部可用过氧化氢溶液+复合抗生素液+生理盐水交替冲洗（D对）；给予抗生素3-5天，防止继发感染（E对）。